某男，52岁。肥胖，嗜好烟酒。胁肋重着疼痛，口苦口黏，胸闷纳呆，小便色黄，大便不爽；舌红苔黄腻，脉弦滑数。超声检查结果提示中度脂肪肝。血液检验结果：总胆固醇8.2mmol/L，三酰甘油（甘油三酯）3.5mmol/L，高密度0.45mmol/L，低密度脂蛋白7.1mmol/L，血清总蛋白55g/L。与脂肪肝发病关系密切的检验指标是
A. 高密度脂蛋白
B. 总胆固醇
C. 低密度脂蛋白
D. 三酰甘油
E. 血清总蛋白

正确答案：D。三酰甘油

解析：本题考查三酰甘油的概念。与脂肪肝发病关系密切的检验指标是三酰甘油（D对）。三酰甘油又称甘油三酯（TG），是甘油和3个脂肪酸所形成的脂类物质，主要在肝脏合成，小肠黏膜在类脂吸收后也合成大量的TG，进食脂肪餐后会导致饮食性脂血。TG主要存在于极低密度脂蛋白（VLDL）和乳糜微粒（CM），可直接参与胆固醇和胆固醇酯的合成。TG是动脉粥样硬化（AS）的独立危险因素和导致脂肪肝的主要原因。高密度脂蛋白（A错）（HDL）是血清中颗粒最小、密度最大的一组脂蛋白（蛋白质和脂质各占50%）。HDL被认为是人体内具有抗动脉粥样硬化的脂蛋白，是抗动脉粥样硬化因子之一，因其可将泡沫细胞中的胆固醇带出来，转运给肝脏进行分解代谢，从而防止动脉粥样硬化的发生。临床上常用高密度脂蛋白胆固醇（HDL-C）的含量反映HDL水平，HDL-C降低有临床意义。总胆固醇（B错）（TC）是脂质的重要组成部分，其中70%是胆固醇酯，30%是游离胆固醇。血清TC升高是引起动脉粥样硬化（AS）、缺血性心脑血管病的重要危险因素。低密度脂蛋白（C错）（LDL）是富含TC的脂蛋白，是导致动脉粥样硬化的基本因素。LDL通过血管内皮进入血管壁内，在内皮下滞留的LDL被修饰成氧化型LDL（Ox-LDL），巨噬细胞吞噬Ox-LDL后形成泡沫细胞，成为动脉粥样硬化板块脂质核心的重要组分。临床上常用的低密度脂蛋白胆固醇（LDL-C）的含量反映LDL水平，LDL-C升高有更重要的临床意义。血清总蛋白（E错）、γ球蛋白、β球蛋白均由肝脏细胞合成，总蛋白为清蛋白和球蛋白之和。血浆蛋白具有维持正常的血浆胶体渗透压、机体免疫、凝血和抗凝血及营养等生理功能。当肝脏受损时，血浆蛋白减少，在炎症性肝细胞破坏和抗原性改变时，可刺激免疫系统致使γ球蛋白比例增高，此刻总蛋白量变化不大，但清蛋白和球蛋白比值（A/G）会变小，甚至发生倒置。为了反映肝脏功能的实际情况，在做血清总蛋白测定的同时，尚需要测定A/G比值。